某男性，年龄25岁，工龄2年，某矿场的采石工。因主诉咳嗽、胸痛、气短等症状就诊。患者自述，采矿场工作条件很差，无防尘措施。X线胸片呈肺纹理增加，伴有块状阴影和典型结节。此种矽肺属何种类型矽肺
A. 晚发性矽肺
B. 速发性矽肺
C. 矽肺
D. 尘肺
E. 煤矽肺

正确答案：B。速发性矽肺

解析：本题考查速发型矽肺的概念。速发型矽肺（B对ACDE错）是指由于持续吸入高浓度、高游离SiO₂含量的粉尘，经1～2年即发病者。该男性的职业史、接触史、症状均符合速发型矽肺的概念，因此所患疾病为速发型矽肺。